常发生耳毒性和肾毒性的药物是
A. 青霉素
B. 四环素
C. 庆大霉素
D. 氯霉素
E. 头孢唑林

正确答案：C。庆大霉素

解析：本题考查庆大霉素的不良反应。庆大霉素（C对）常见不良反应为耳毒性、肾毒性和过敏反应等。青霉素（A错）不良反应主要是过敏反应。四环素（B错）不良反应有肠道菌群失调、肝毒性、牙齿黄染等。氯霉素（D错）不良反应为对骨髓造血功能的抑制。头孢唑林（E错）不良反应有皮疹、瘙痒、斑丘疹、荨麻疹、过敏性休克甚至死亡。